不用煨法炮制的药物是
A. 肉豆蔻
B. 木香
C. 草豆蔻
D. 诃子
E. 葛根

正确答案：C。草豆蔻

解析：本题考查的是煨法。不用煨法炮制的药物是草豆蔻（C错，为本题正确答案）。煨法是将净制或切制后的药物用湿面皮或湿纸包裹，或吸油纸均匀隔层分放，进行加热处理，或将药物与麦麸同置炒制容器内用文火加热至规定程度的方法。煨法的目的：①除去药物中部分挥发性及刺激性成分，从而降低副作用，如肉豆蔻（A对）。②增强疗效，如肉豆蔻。③缓和药性，如诃子（D对）、葛根（E对）。木香（B对）：处方用名有木香、广木香、云木香、煨木香。